患者，女，50岁。5天前左足第三、四趾缝足癣水疱溃破，次日局部红肿疼痛，并见红线1条向上走窜至小腿中段，边界清晰，伴有发热，左胯腹部淋巴结肿痛。其诊断是
A. 流火
B. 流注
C. 青蛇毒
D. 蛇串疮
E. 红丝疔

正确答案：E。红丝疔

解析：流火为丹毒发生于小腿足部者，丹毒为患部皮肤突然发红成片、色如涂丹的急性感染性疾病（A错）。流注是发生于肌肉深部的急性化脓性疾病，题中病变在皮肤，而非肌肉（B错）。青蛇毒是体表筋脉发生的炎性血栓性疾病（C错）。蛇串疮是一种皮肤上出现成簇水疱，多呈带状分布，痛如火燎的急性疱疹性皮肤病（D错）。题中病例患者病变发于下肢，外因足癣水疱溃破，或由于感染邪毒或内有火毒，故毒流经脉向上走窜，故见红肿疼痛，红线1条向上走窜至小腿中段，伴有发热，左胯腹部淋巴结肿痛，为红丝疔的典型表现（E对）。